血栓性浅静脉炎多发于
A. 上肢静脉
B. 下肢静脉
C. 胸壁静脉
D. 颈静脉
E. 面部静脉

正确答案：B。下肢静脉

解析：血栓性浅静脉炎是发生于体表浅静脉的血栓性、炎性病变。临床表现以浅静脉走行处呈条索状突起、色赤、形如蚯蚓、硬而疼痛为特征，多发于青壮年，以四肢为多见，次为胸腹壁（B对）。